麻黄平喘作用的主要活性成分是
A. 去甲基麻黄碱
B. 甲基麻黄碱
C. 麻黄碱
D. 麻黄次碱
E. 麻黄根碱

正确答案：C。麻黄碱

解析：本题考查的是麻黄的药理作用。麻黄平喘作用的主要活性成分是麻黄碱（C对）。麻黄的药理作用：（1）发汗：麻黄水煎剂、麻黄挥发油、麻黄碱使大鼠足跖部汗液分泌增多，其作用机制是通过影响下丘脑体温调节中枢，启动散热过程，兴奋外周α₁受体，阻碍汗腺导管对钠离子的重吸收。（2）平喘、镇咳、祛痰：麻黄水煎液、麻黄醇提取物、麻黄生物碱、麻黄碱均具有平喘、镇咳作用。麻黄挥发油具有祛痰作用。（3）利尿：麻黄具有一定的利尿作用，且以D-伪麻黄碱的作用最明显。（4）解热、镇痛、抗炎：麻黄水煎液、麻黄挥发油具有显著的解热作用。麻黄挥发油和萜松醇对正常小鼠体温有降低作用。麻黄挥发油、麻黄水煎液对热刺激小鼠有显著镇痛作用。麻黄水提物、醇提物均有明显的抗炎作用，伪麻黄碱、甲基麻黄碱（B错）、麻黄碱是抗炎作用的主要有效成分。麻黄唑酮是麻黄中新分离出的具有抗炎活性的成分。麻黄生物碱具兴奋中枢神经系统及强心、升高血压的作用，因此用量过大（治疗量的5～10倍）或急性中毒者，可引起头痛，烦躁，失眠，心悸，大汗不止，体温及血压升高，心动过速，心律失常，呕吐，甚至昏迷、惊厥、呼吸及排尿困难，心室纤颤等症状，甚至心肌梗死或死亡。麻黄根碱（E错）存在于麻黄根中，具有降低血压作用。去甲基麻黄碱（A错）与麻黄次碱（D错）的药理作用，2022年考试指南未明确说明。